关于中药提取，固-液分离方法是
A. 水蒸气蒸馏法
B. 沉降分离法
C. 离心分离法
D. 大孔树脂吸附法
E. 滤过分离法

正确答案：B、C、E。沉降分离法；离心分离法；滤过分离法

解析：本题考查中药的分离方法。关于中药提取，固-液分离方法是沉降分离法（B对）、离心分离法（C对）、滤过分离法（E对）。将固体-液体非均相体系用适当方法分开的过程称为固-液分离。中药提取液的精制、药物重结晶等均要进行分离操作；注射剂的除菌也用到分离技术。分离方法一般有三类：沉降分离法、离心分离法和滤过分离法。中药浸提方法的选择应根据处方药料特性、溶剂性质、剂型要求和生产实际等因素综合考虑。常用的浸提方法主要有煎煮法、浸渍法、渗漉法、回流法、水蒸气蒸馏法（A错）等。精制系采用适当的方法和设备除去中药提取液中杂质的操作。常用的精制方法有：水提醇沉淀法、醇提水沉淀法、大孔树脂吸附法（D错）、超滤法、盐析法、酸碱法、澄清剂法、透析法、萃取法等，其中以水提醇沉法应用尤为广泛。